可摘义齿不稳定的表现不包括
A. 咀嚼效率低
B. 游离端基托翘起
C. 摆动
D. 旋转
E. 义齿下沉

正确答案：A。咀嚼效率低

解析：本题考查义齿不稳定的临床表现。咀嚼效率低可能与咬合关系不正确，人工牙（牙合）面过低过小与对颌牙接触不良，（牙合）面平坦，无适当的牙尖斜度或垂直距离低可造成义齿咀嚼效率低（A错，为本题的正确答案）。义齿不稳定的临床表现：（1）翘起（B对）：游离端义齿受食物黏着力、上颌义齿重力等作用，游离端基托向（牙合）向转动脱位。（2）摆动（C对）：义齿游离端受侧向力作用而造成颊、舌向水平的摆动。（3）旋转（D对）：义齿绕支承线轴转动。如横线式和斜线式支点线形成前后（近远中）向旋转，纵线式支点线形成颊舌向旋转。（4）下沉（E对）：义齿受（牙合）力作用时基托压向其下的黏膜组织。黏膜支持式义齿及某些混合支持式义齿易出现此现象。